用于治疗原发性支气管肺癌气滞血瘀证的方剂是
A. 肾气丸
B. 右归丸
C. 血府逐瘀汤
D. 酸枣仁汤
E. 天王补心丹

正确答案：C。血府逐瘀汤

解析：原发性支气管肺癌气滞血瘀证的机理为气滞血瘀，痹阻于肺，肺络气机不利，故以咳嗽、咳痰，胸闷胀痛为主症；血瘀日久，则面青唇暗，肺中积块，舌质暗紫或有瘀斑瘀点，脉弦或涩，故其治法为活血散瘀，行气化滞，方药选用活血化瘀，行气止痛的血府逐瘀汤加减（C对）。肾气丸（A错）可补肾助阳，治疗肾阳不足证；右归丸（B错）可温补肾阳，填精益髓，治疗肾阳不足，命门火衰证；酸枣仁汤（D错）可清热除烦，养血安神，治疗肝血不足，虚热扰神证；天王补心丹（E错）可补心安神，滋阴清热，治疗阴亏内热，心神不宁证。